患者女性，48岁，糖尿病史9年，外阴痒2月余。妇检：阴道黏膜充血，白带多，呈凝乳块状。本例最可能的诊断是
A. 老年性阴道炎
B. 外阴硬化性苔藓
C. 念珠菌阴道炎
D. 细菌性阴道病
E. 滴虫性阴道炎

正确答案：C。念珠菌阴道炎